依照对医疗机构执业要求的规定，医疗机构有以下义务，除了
A. 必须承担相应的预防工作
B. 必须承担相应的医疗卫生知识的宣传普及工作
C. 必须承担相应的保健工作
D. 承担卫生行政部门委托的支援农村的任务
E. 承担卫生行政部门委托的指导基层医疗卫生工作的任务

正确答案：B。必须承担相应的医疗卫生知识的宣传普及工作

解析：医疗机构执业规则：医疗机构必须承担相应的预防保健工作，承担县级以上人民政府卫生行政部门委托的支援农村、指导基层医疗卫生工作等任务。掌握“医疗机构概述及机构执业”知识点。